为延长脂质体在体内循环时间，通常使用修饰的磷脂制成长循环脂质体，常用的修饰材料是
A. 甘露醇
B. 聚山梨醇
C. 山梨醇
D. 聚乙二醇
E. 聚乙烯醇

正确答案：D。聚乙二醇

解析：本题考查长循环脂质体。聚乙二醇（PEG）（D对）修饰可增加脂质体的柔顺性和亲水性，从而降低与单核巨噬细胞的亲和力，延长循环时间，称为长循环脂质体。长循环脂质体有利于肝脾以外的组织或器官的靶向作用，同时，将抗体或配体结合在PEG的末端，既可保持长循环，又可保持对靶体的识别。甘露醇（A错）是一种高渗性的组织脱水剂，临床上广泛应用于治疗脑水肿，预防急性肾衰，治疗青光眼，加速毒物及药物从肾脏的排泄。聚山梨醇（B错）是一大类非离子表面活性剂，具有乳化、扩散、增溶、稳定等作用。山梨醇（C错）可作为营养型甜味剂、湿润剂、螯合剂和稳定剂使用。聚乙烯醇（E错）用于纺织浆料、涂料、黏合剂、乳化剂、薄膜。